临床表现为洞内软化牙本质相对较少，着色深，洞底牙本质硬，光滑的龋病是
A. 急性龋
B. 平滑面龋
C. 慢性龋
D. 浅龋
E. 静止龋

正确答案：C。慢性龋

解析：慢性龋：龋的进程多缓慢、持续，临床表现为洞内软化牙本质相对较少，着色深，质地相对干硬，不易用手用器械去除，洞底可见硬化牙本质，黄褐色，坚硬而光滑。掌握“龋病的临床表现与分类”知识点。